布散于皮肤肌肉和孔窍的主要是
A. 精
B. 气
C. 血
D. 津
E. 液

正确答案：D。津

解析：《灵枢·决气》：“腠理发泄，汗出溱溱，是谓津。”“故布散于皮肤肌肉和孔窍的主要是津（D对）。人体之精贮藏于脏腑身形中。肾所藏先天之精，作为生命本原，在胎儿时期便贮藏于各脏腑之中。后天之精则经由脾肺等输送到各脏，化为各脏腑之精，并将部分输送于肾中，以充养肾所的先天之精（A错）；气是构成和维持人体生命活动的最基本物质（B错）；血在脉道中运行不息，流布全身，环周不休（C错）；液灌注于骨节、脏腑、脑、髓等组织器官（E错）。